下列关于流行性感冒的流行特征叙述错误的是
A. 先城市后农村
B. 先平原后山区
C. 乙型流感病毒流行呈现周期性
D. 儿童感染率最高
E. 男女之间发病没有差异

正确答案：C。乙型流感病毒流行呈现周期性